女，30岁，自服安定约100粒，由家属送入院。查体：意识模糊，言语不清，四肢肌力差。血气分析：PaO₂49mmHg，PaCO₂53mmHg。引起该患者血气变化的主要机制是
A. 通气/血流比例升高
B. 阻塞性通气功能障碍
C. 弥散功能
D. 解剖分流增加
E. 肺泡通气量下降

正确答案：E。肺泡通气量下降

解析：患者青年女性，自服过量安眠药。查体：意识模糊，四肢肌力差（提示呼吸肌可能受累）。血气分析：PaO₂49mmHg（＜60mmHg），PaCO₂53mmHg（＞50mmHg），易诊断为Ⅱ型呼吸衰竭。系肺泡通气不足所致（E对）。通气/血流比例升高（A错）、弥散功能（C错）下降、解剖分流增加（D错）均为引起肺换气障碍所致的Ⅰ型呼吸衰竭的机制。